女性，21岁学生，不慎溺水后2小时出现呼吸困难急诊入院。查体：BP90/60mmHg，R40次/分，P120次/分。烦躁不安，唇发绀，双肺可闻及湿啰音，胸片示双肺呈大片状浸润阴影。假设诊断成立，在治疗中应及早使用的是
A. 高浓度鼻导管吸氧
B. 增加输液量
C. 面罩吸氧
D. 输胶体液
E. PEEP

正确答案：E。PEEP

解析：患者年轻女性，有溺水史（是急性呼吸窘迫综合征的常见危险因素），出现有呼吸困难，查体有血压下降，呼吸及心率增快，口唇发绀，两肺有湿啰音，胸片有大片状浸润阴影，根据其临床表现和体征，考虑诊断为急性呼吸窘迫综合症，故应首先进行机械通气，主要措施包括合适水平的PEEP（E对）和小潮气量。高浓度鼻导管吸氧（A错）、面罩吸氧（C错）可提高PaO₂，但是多数患者需使用机械通气。ARDS的患者以可以允许的较低循环容量来维持有效循环，严格控制输入的液体量，保持体液的负平衡，每天出入液体量一般控制在入量比出量少500ml左右，故不应增加输液量（B错）。ARDS早期，除非有低蛋白血症，否则不宜输注胶体液（D错）。